一些学者认为龋病发生、发展被划分为以下几个阶段：动态稳定阶段、产酸阶段和耐酸阶段，属于以下哪种学说
A. 蛋白溶解-螯合学说
B. 广义龋病生态学假说
C. 蛋白溶解学说
D. 龋病病因的四联因素理论
E. 化学细菌学说

正确答案：B。广义龋病生态学假说

解析：本题考查龋病概述。广义龋病生态学假说（B对）：一些学者认为龋病发生、发展被划分为以下几个阶段：①动态稳定阶段、②产酸阶段、③耐酸阶段。